关于胃酸的生理作用，下列哪项错误
A. 激活胃蛋白酶原，提供酸性环境
B. 使食物中的蛋白变性，易于分解
C. 杀菌
D. 促进维生素B₁₂吸收
E. 盐酸进入小肠，促进胰液、胆汁等的分泌

正确答案：D。促进维生素B₁₂吸收